女，54岁。阴道脱出肿物3年。妇科检查：阴道前壁膨出，宫颈光滑，用力时宫颈及部分宫体脱出阴道口外。该患者应诊断为阴道前壁膨出和子宫脱垂
A. Ⅱ度轻型
B. Ⅰ度重型
C. Ⅰ度轻型
D. Ⅱ度重型
E. Ⅲ度

正确答案：D。Ⅱ度重型

解析：中年女性，阴道脱出肿物3年，妇科检查：阴道前壁膨出，宫颈光滑，用力时宫颈及部分宫体脱出阴道口外，患者应诊断为阴道前壁膨出和子宫脱垂Ⅱ度重型（D对），I度轻型（C错）宫颈外口距处女膜缘<4cm, 未达处女膜缘；I度重型（B错）宫颈已达处女膜缘，阴道口可见子宫颈。II度轻型（A错）宫颈脱出阴道口，宫体仍在阴道内；III度（E错）宫颈与宫体全部脱出阴道口外。